大黄治血热吐衄，常配伍的药组是
A. 厚朴，枳实
B. 紫苏，陈皮
C. 石膏，知母
D. 薤白，青皮
E. 黄连，黄芩

正确答案：E。黄连，黄芩

解析：治疗血热吐衄当以清心凉血止血，以黄连、黄芩苦寒泻心火，清胃火，胃气下泄，则心火有所消导，而胃中之热气，亦不上壅,斯气顺而血不逆矣，配伍大黄之苦寒通降以止其血，使血止而不留瘀（E对）。